水溶性他汀类药物能够选择性抑制肝脏胆固醇合成，而对肾上腺、性腺、心脏、大脑等部位的胆固醇合成影响极低，既有效降低了血清胆固醇水平，又减少了肝脏以外组织不良反应的发生。水溶性较强的他汀类药物是
A. 洛伐他汀
B. 普伐他汀
C. 辛伐他汀
D. 氟伐他汀
E. 阿托伐他汀

正确答案：B。普伐他汀

解析：本题考查他汀类药物。水溶性较强的他汀类药物是普伐他汀（B对）。不同他汀类药物的组织分布存在一定差异，这与其亲脂亲水特性相关，从而导致了疗效和不良反应的差异。内酯环型他汀有洛伐他汀（A错）和辛伐他汀（C错），属于脂溶性他汀，口服吸收率较低；须在肝脏中水解成开环羟基酸型方有药理活性。其余他汀类均为开环羟基酸型，水溶性较强（普伐他汀和瑞舒伐他汀）或兼具脂溶性和水溶性（氟伐他汀（D错）、阿托伐他汀（E错）和匹伐他汀），具有较高的吸收率，一般不受食物影响。与脂溶性他汀相比，水溶性他汀不易透过细胞膜的脂质层，但可以通过肝细胞表面的输送载体，选择性进入肝细胞。因此，水溶性他汀能够选择性抑制肝脏胆固醇合成，而对肾上腺、性腺、心脏、大脑等部位的胆固醇合成影响极低。这样，既有效降低了血清胆固醇水平，又避免了肝外组织不良反应的发生。